龋病治疗，以下说法正确的是
A. 原则上应去尽龋坏组织
B. 用挖器从洞底向四周去除深部龋坏组织
C. 用锋利裂钻去除深部龋坏组织
D. 急性深龋近髓，一次性去除龋坏
E. 去尽再矿化牙本质

正确答案：A。原则上应去尽龋坏组织

解析：本题考查龋病的治疗。龋病治疗原则上应去尽龋坏组织（A对），以消除感染和刺激物，终止龋病发展，防止继发龋发生。去腐时应从四周向洞底去除深部龋坏组织，洞较深时不必强调底平壁直，将所有腐质去净即可，若从洞底向四周去除容易露髓（B错）。去除深部龋坏组织时需用刮匙或球钻仔细去除，使用锋利裂钻可能会造成意外露髓（C错）。急性深龋近髓，一次性去除龋坏组织，易导致穿髓，应采用二次去腐法（D错）。慢性龋进展缓慢，修复反应强，早期病变组织可重新矿化，此种再矿化牙本质颜色较正常牙本质深，但质硬，应予以保留（E错）。